下列哪项不属于环境介质
A. 大气
B. 水体
C. 土壤
D. 生物体
E. 有机和无机物

正确答案：E。有机和无机物

解析：本题考查环境介质。环境介质是指空气（A对）、水（B对）、土壤（C对）（岩石）以及包括人体在内的所有生物体（D对）。有机和无机物（E错，为本题正确答案）不属于环境介质，它们是环境介质的组成部分，而不是环境介质本身。